确定化合物分子量常采用的方法是
A. NMR
B. IR
C. UV
D. MS
E. DEPT

正确答案：D。MS

解析：本题考查的是化合物结构鉴定方法。确定化合物分子量常采用的方法是MS（D对）。MS即质谱，质谱可用于确定分子量及求算分子式和提供其他结构信息。¹³C-NMR（A错）属于核磁共振谱。核磁共振谱：分为核磁共振氢谱（¹H-NMR）和核磁共振碳谱（¹³C-NMR）主要用于测定分子中质子和碳原子的类型、数目、相邻的原子或原子团。IR（B错）为红外光谱，红外光谱主要用于鉴别分子中的特征官能团，某些情况下，IR光谱可用于区别芳环的取代方式、构型及构象等。UV-Vis（C错）为紫外-可见吸收光谱，紫外-可见吸收光谱对于分子中含有共轭双键、α，β-不饱和羰基（醛、酮、酸、酯）结构的化合物以及芳香化合物的结构鉴定来说是一种重要的手段，通常主要用于推断化合物的骨架类型，还可用于测定化合物的精细结构。DEPT谱（E错）可以认为是¹³C-NMR核磁共振碳谱的一种，是对一般¹³C-NMR核磁共振碳谱的优化，其功能与¹³C-NMR核磁共振碳谱相同。